依照《中华人民共和国行政复议法》，下列表述正确的是
A. 申请行政复议的公民、法人或者其他组织是申请人
B. 申请人、第三人可以委托代理人代为参加行政复议
C. 有权申请行政复议的公民死亡的，其近亲属不可以申请行政复议
D. 申请人申请行政复议，可以口头申请
E. 申请人向人民法院提起，行政诉讼，人民法院已经依法受理的，不得申请行政复议

正确答案：A、D。申请行政复议的公民、法人或者其他组织是申请人；申请人申请行政复议，可以口头申请

解析：本题考查的是行政复议的申请。依照《中华人民共和国行政复议法》，下列表述正确的是申请行政复议的公民、法人或者其他组织是申请人（A对）；申请人申请行政复议，可以口头申请（D对）。行政复议申请人：申请人是指认为具体行政行为侵犯其合法权益，依法申请复议的公民、法人或其他组织。行政机关在作为行政管理对象时，可以作为机关法人成为申请人。（1）申请人的条件：第一，申请人必须是行政相对人，包括公民、法人或者其他组织以及外国人、无国籍人。第二，申请人是认为具体行政行为侵害其合法权益的人。第三，申请人必须是以自己的名义申请行政复议的公民、法人或者其他组织。（2）申请人资格的转移：一般情况下，具体行政行为侵害的当事人是行政复议的申请人。但在特定条件下，行政复议申请人的资格也可能发生转移。根据《行政复议法》第10条的规定，行政复议申请人资格转移的情况有2种。第一，有权申请行政复议的公民死亡，其近亲属可以申请行政复议（C错）。近亲属包括配偶、父母、子女、兄弟姐妹、祖父母、外祖父母、孙子女、外孙子女。第二，有权申请行政复议的法人或者其他组织终止，承受其权利的法人或者其他组织可以申请行政复议。行政复议的申请：公民、法人或者其他组织认为具体行政行为侵犯其合法权益，可以自知道该具体行政行为之日起60日内提出行政复议申请。法律规定的申请期限超过60日的，从其规定。因不可抗力或其他正当理由耽误法定申请期限，申请期限自障碍消除之日起继续计算。申请人申请行政复议，可以书面申请，也可以口头申请。”